生存率的标准误
A. 是反映平均水平的指标
B. 可用生存率曲线来比较
C. 可反映生存时间与结局的趋势
D. 用来说明生存率抽样误差的大小
E. 与标准差一样，可用来说明个体变异的大小

正确答案：D。用来说明生存率抽样误差的大小